目前翻瓣术后最常见愈合方式为
A. 骨结合
B. 胶原连结
C. 长结合上皮愈合
D. 新附着
E. 细胞结合

正确答案：C。长结合上皮愈合

解析：本题考查慢性牙周炎的治疗原则、程序及方法。长结合上皮愈合（C对）：在袋内壁与原来暴露于牙周袋内的牙根表面之间有一层长而薄的结合上皮，称为长结合上皮，以半桥粒体和基底板的方式连接。这种愈合方式称为长结合上皮愈合，但并非真正的附着获得。这是翻瓣术后最常见的愈合方式。